对由营养不良、婴儿期所致的恶性贫血者应选用
A. 叶酸+维生素B₁₂
B. 富马酸亚铁
C. 维生素K₁
D. 甲磺酸去铁胺
E. 亚叶酸钙

正确答案：A。叶酸+维生素B₁₂

解析：本题考查治疗巨幼红细胞性贫血的药物。由营养不良、婴儿期所致的恶性贫血应该补充外源性叶酸和维生素B₁₂（A对）。富马酸亚铁（B错）可用于缺铁性贫血。维生素K₁（C错）用于维生素K缺乏引起的出血性疾病。甲磺酸去铁胺（D错）为铁中毒的解毒剂。亚叶酸钙（E错）用于由甲氨蝶呤引发的贫血。